以下各项头颈部淋巴结中，不属于纵形组淋巴结群的是
A. 锁骨上淋巴结
B. 副神经淋巴结
C. 耳后淋巴结
D. 颈二腹肌淋巴结
E. 颈肩胛舌骨肌淋巴结

正确答案：C。耳后淋巴结

解析：纵形组淋巴结群包括咽后群、颈前群及颈外侧群。颈外侧群分为颈浅淋巴结和颈深淋巴结。也可按其位置可分为副神经淋巴结、锁骨上淋巴结、颈深上淋巴结和颈深下淋巴结四组，其中颈深上淋巴结又可分为颈二腹肌淋巴结和颈肩胛舌骨肌淋巴结。掌握“头颈部淋巴的分组”知识点。